女，36岁。月经稀发3年，停经1年。实验室检查：血FSH48U/L、雌激素10pg/ml。最可能的诊断为
A. 子宫内膜不规则脱落
B. 卵巢早衰
C. 黄体功能不足
D. 多囊卵巢综合征
E. 子宫内膜异位症

正确答案：B。卵巢早衰

解析：该36岁（40岁前）患者。月经稀发3年，停经1年（为继发性闭经，指正常月经建立后月经停止6个月，或按自身原有月经周期计算停止3个周期以上者）。实验室检查：血FSH（卵泡刺激素）48U/L（＞40U/L，FSH升高），雌激素10pg/ml（E2≤30pg/ml，说明雌激素水平下降），故最可能的诊断是卵巢早衰（B对）。子宫内膜不规则脱落（P351）（A错）表现为月经周期正常，但经期延长，长达9～10日，且出血量多。黄体功能不足（P350）（C错）表现为月经周期缩短，有时月经周期虽在正常范围内，但卵泡期延长、黄体期缩短，以致患者不易受孕或在妊娠早期流产，无FSH升高伴雌激素水平下降。多囊卵巢综合征（P359）（D错）以高雄激素、持续无排卵、卵巢多囊改变为特征，常伴有胰岛素抵抗和肥胖，实验室检查血FSH正常或偏低，雌激素水平正常或升高。